女性内生殖器官不包括
A. 阴阜
B. 输卵管
C. 阴道
D. 子宫
E. 卵巢

正确答案：A。阴阜

解析：本题考查女性性器官。女性生殖器，包括女性内生殖器和女性外生殖器。女性外生殖器指生殖器官的外露部分，又称外阴，包括阴阜（A错，为本题正确答案）、大、小阴唇、 阴蒂、阴道口等。女性内生殖器由卵巢（E对）、输卵管（B对）、子宫（D对）和阴道（C对）组成。